与牙槽骨的形成有关的细胞为
A. 成纤维细胞
B. 牙周膜干细胞
C. 成牙骨质细胞
D. Malassez上皮剩余
E. 成骨细胞

正确答案：E。成骨细胞

解析：骨形成时，成骨细胞活跃，骨吸收时则破骨细胞活跃。掌握“牙周膜”知识点。